最具有疗效的盖髓药物是
A. 聚羧酸锌水门汀
B. 氢氧化钙制剂
C. 抗炎剂
D. 酶类
E. 抗炎剂+抗生素

正确答案：B。氢氧化钙制剂

解析：氢氧化钙和MTA是最具有疗效的盖髓剂。掌握“盖髓术”知识点。